人体活动的直接供能物质是
A. 葡萄糖
B. 硬脂酸
C. 丙氨酸
D. 三磷酸腺苷
E. 磷酸肌醇

正确答案：D。三磷酸腺苷

解析：生命活动中能量的直接供体是三磷酸腺苷（ATP）（D对）。它是体内最重要的高能磷酸化合物，是细胞可直接利用的能量形式。葡萄糖（A错）、硬脂酸（B错）、丙氨酸（C错）等营养物质在体内经分解代谢，逐步释放能量，其中有相当一部分能量需要驱动二磷酸腺苷（ADP）磷酸化生成ATP，供细胞直接利用。磷酸肌酸（P187）（E错）是高能键能量的储存形式，主要存在于骨骼肌、心肌和脑，可在ATP迅速消耗时将～P转移给ADP，生成ATP，补充ATP的不足。